女，38岁，接触性出血1月余，白带有恶臭，妇科检查，宫颈Ⅱ°糜烂，前唇有5cm×3cm的质地脆赘生物，易出血。子宫正常大，三合诊（-）。为确定诊断，最可靠的诊断方法为
A. 宫颈刮片细胞学检查
B. 碘试验
C. 阴道镜检查
D. 氮激光肿瘤固有荧光诊断法
E. 宫颈活检

正确答案：E。宫颈活检

解析：该患者有接触性出血、白带伴恶臭（宫颈癌常表现为接触性出血，晚期患者因癌组织坏死伴感染，可有大量米泔样或脓性恶臭白带），妇检：宫颈Ⅱ度糜烂，前唇有5cm×3cm的质地脆赘生物，易出血（外生型子宫颈癌可见息肉状、菜花状赘生物，常伴感染，质脆易出血），最可能的诊断是子宫颈癌。根据宫颈癌的“三阶梯”程序，确诊依据是组织学检查即宫颈活检（E对）。宫颈刮片细胞学检查（A错）（P303）主要用于早期宫颈癌的筛查。碘试验（P303）（B错）主要用于宫颈病变部位的定位，结合阴道镜检查（P303）（C错）进行组织活检，可明确诊断。氮激光肿瘤固有荧光诊断法（D错）主要用于癌症的早期筛查，可通过分析被检组织发出的荧光色泽判断其是否癌变或癌前病变。